右归丸除温补肾阳外，还具有的功用是
A. 填精益髓
B. 补益脾胃
C. 理气健脾
D. 散寒止痛
E. 纳气平喘

正确答案：A。填精益髓

解析：右归丸功效温补肾阳，填精益髓，主治肾阳不足，命门火衰证；方中附子、肉桂温壮元阳，鹿角胶温肾阳，益精血，生地、山茱萸、枸杞、少阳滋阴益肾，填精益髓，菟丝子、杜仲补肝肾，强腰膝，当归养血补肝，方中补阳药与补阴药相配，阴中求阳，纯补无泻，方中诸多补药温补肾阳，填精益髓（A对）。